合理用药经济性的正确含义是
A. 用药投入的成本（成本／效果）应尽可能低
B. 用药者承受的治疗风险应尽可能小
C. 用药疗程应尽可能短
D. 用药者的生理功能提高应尽可能快
E. 用药后发生的不良反应应尽可能少

正确答案：A。用药投入的成本（成本／效果）应尽可能低

解析：本题考查合理用药经济性的含义。合理用药经济性的正确含义是用药投入的成本（成本／效果）应尽可能低（A对）。药物治疗的经济性就是要以最低的药物成本，实现最好的治疗效果。制定药物治疗方案时要考虑治疗的总成本，而不是单一的药费。